男，45岁，既往有消化性溃疡病史，上腹部剧烈疼痛3小时，随即蔓延至全腹，呈持续性。查体：板状腹，全腹压痛及反跳痛，肠鸣音消失，确诊需要做的最重要的检查是
A. 直肠指诊
B. 诊断性腹腔穿刺
C. 腹部立位X线平片
D. 腹部B超
E. 血常规

正确答案：C。腹部立位X线平片

解析：中年男性患者，既往有消化性溃疡病史，上腹部剧痛3小时，随即蔓延至全腹，查体表现为板状腹，全腹压痛及反跳痛（腹膜刺激征），肠鸣音消失（提示腹腔空腔脏器穿孔），结合患者病史和体查，最可能的诊断为急性消化性溃疡穿孔。为明确诊断，最重要的检查是腹部立位X线平片（C对）。溃疡穿孔后，胃肠道内气体进入腹腔，立位时积聚于膈下，腹部立位X线平片表现为膈下新月状游离气体影，患者若腹部立位X线平片出现上述典型表现，结合病史和体查多可确诊。直肠指诊（A错）主要用于直肠癌、腹腔脓肿的诊断，对消化性溃疡穿孔的诊断价值不大。诊断性腹腔穿刺在消化性溃疡穿孔早期多为阴性，故不选用（B错）。腹部B超（D错）常用于实质脏器，如肝、胆、胰等病变的诊断。血常规（E错）为一般常规检查，无特异性。